下列哪项不属于健康促进涉及的主要领域
A. 制定能促进健康的公共政策
B. 加快医疗机构的改革
C. 加强社区的行动
D. 发展个人技能
E. 创造支持的环境

正确答案：B。加快医疗机构的改革